深静脉血栓形成最常见于
A. 上肢深静脉
B. 上腔静脉
C. 下腔静脉
D. 门静脉
E. 下肢深静脉

正确答案：E。下肢深静脉

解析：下肢深静脉瓣膜数量多，瓣膜处血流缓慢，且容易出现涡流，可损伤血管内皮，使其暴露出内皮下胶原并释放多种生物活性物质，启动内、外源性凝血途径，导致血栓形成。此外，下肢静脉回流需克服静水压，因而血流速度缓慢，有利于血栓形成。综上，深静脉血栓形成最常见于下肢深静脉（E对）。